由于老年人胃肠道功能变化，而导致按主动转运方式吸收减少的药品是
A. 维生素B₁
B. 阿司匹林
C. 对乙酰氨基酚
D. 苯巴比妥
E. 磺胺甲噁唑

正确答案：A。维生素B₁

解析：本题考查老年人用药。由于老年人胃肠道功能变化，而导致按主动转运方式吸收减少的药品是维生素B₁（A对）。阿司匹林（B错）、对乙酰氨基酚（C错）、苯巴比妥（D错）和磺胺甲噁唑（E错）均经被动吸收入血，老年人胃肠道功能的变化对其吸收影响不大。